关于妄想，下列说法正确的是
A. 在意识障碍时出现的杂乱思维
B. 在智力缺损时出现的离奇想法
C. 在意识清晰的情况下的病理性歪曲信念
D. 是可被说服的不现实想法
E. 在意识中占主导地位的错误观念

正确答案：C。在意识清晰的情况下的病理性歪曲信念

解析：妄想是一种病理性的歪曲信念，发生于意识清晰的情况下，是病态推理和判断基础上的结果（C对）。妄想内容与事实不符，缺乏客观现实基础，但患者仍坚信不移，不可被说服（D错）。